患者，女，24岁，G1P1，现孕36周，因“先兆子痫”入院。入院2天后，经治疗血压维持在165/120mmHg，自感视物模糊，现自数胎动减少，做NST为无反应型，再做B型超声，生物物理评分为4分。应首选的治疗措施是
A. 立即终止妊娠
B. 继续治疗妊娠高血压病至妊娠37周
C. 次日复查NST
D. 吸氧观察
E. 做OCT

正确答案：A。立即终止妊娠

解析：患者现孕36周，先兆子痫入院后，经治疗血压持续在165/120mmHg，感视物模糊，现自数胎动减少，为预测胎儿宫内储备能力，做NST（无应激试验）为无反应型，多提示胎儿在宫内缺氧。应积极处理，全面评估胎儿状况，做B型超声生物物理评分为4分，应首选的治疗措施是立即终止妊娠（A对）。做NST（无应激试验）为无反应型，多提示胎儿在宫内缺氧，应立即终止妊娠，不能继续治疗妊娠高血压病至妊娠37周（B错）。做NST为无反应型，再做B型超声生物物理评分为4分，应立即终止妊娠（C错）。妊娠期高血压有缺氧情况可吸氧观察辅助治疗（D错）。做OCT是了解胎盘于宫缩时一过性缺氧的负荷试验，以测定胎儿的储备能力（E错）。